关于鼓室的描述错误的是
A. 是颞骨内的一含气不规则小腔隙
B. 鼓室壁内面覆有粘膜
C. 内有听小骨、韧带、肌、血管、神经等
D. 以鼓膜与外耳相隔
E. 以上都不是

正确答案：E。以上都不是

解析：鼓室是颞骨岩部内含气的不规则小腔（A对）。鼓室由6 个壁围成，内有听小骨、韧带、肌、血管和神经等（C对）。鼓室内面及上述结构均被覆有黏膜（B对）。鼓室借鼓膜与外耳道相隔（D对，故E为本题正确答案）。